根据《中华人民共和国药品管理法实施条例》，已在我国销售的国外药品，其药品证明文件有效期届满未申请再注册，应注销
A. 《药品生产许可证》
B. 《进口药品注册证》
C. 《医疗产品注册证》
D. 《医疗机构执业许可证》
E. 《医药产品许可证》

正确答案：B。《进口药品注册证》

解析：本题考查药品管理。根据《中华人民共和国药品管理法实施条例》，已在我国销售的国外药品，其药品证明文件有效期届满未申请再注册或者经审查不符合国务院药品监督管理部门关于再注册的规定的，注销其药品批准文号、《进口药品注册证》（B对）或者《医药产品注册证》。